休克期反映器官血流灌注最简单可靠的指标是
A. 收缩压
B. 舒张压
C. 脉压
D. 脉率
E. 尿量

正确答案：E。尿量

解析：休克的一般监测指标有5项，即精神状态、皮肤温度色泽、血压、脉率和尿量。其中，尿量是反映器官血流灌注最简单可靠的指标。尿少通常是早期休克和休克复苏不完全的表现。尿量＜25ml/h、比重增加者表明仍存在肾血管收缩和供血量不足；血压正常但尿量仍少且比重偏低者，提示有急性肾衰竭可能。当尿量维持在30ml/h以上时，则休克已纠正（E对）。收缩压（A错）主要反映左心室射血量和左心功能。舒张压（B错）主要反映外周血管阻力。脉压（C错）为收缩压减去舒张压，升高提示甲亢、主动脉关闭不全或动脉硬化，减小提示主动脉狭窄、心包积液等，不能有效反应血流灌注。脉率（D错）改变可以由多种疾病引起，不能有效反应血流灌注情况。